根据《医疗机构制剂注册管理办法（试行）》，医疗机构制剂批准文号有效期为
A. 1年
B. 2年
C. 3年
D. 4年
E. 5年

正确答案：C。3年

解析：本题考查的是医疗机构制剂注册制度。根据《医疗机构制剂注册管理办法（试行）》，医疗机构制剂批准文号有效期为3年（C对）。《药品管理法》规定，医疗机构配制的制剂，应当是本单位临床需要而市场上没有供应的品种，并应当经所在地省级药品监督管理部门批准；但是，法律对配制中药制剂另有规定的除外。获得《医疗机构制剂许可证》的医疗机构，如果要进行某种制剂的配制，还必须报送有关资料和样品，经所在地省级药品监督管理部门批准，发给制剂批准文号后，方可配制。医疗机构制剂的申请人应当是持有《医疗机构执业许可证》并取得《医疗机构制剂许可证》的医疗机构。医疗机构配制制剂，应当按照经核准的工艺进行，所需的原料、辅料和包装材料等应当符合药用要求，不得擅自变更工艺、处方、配制地点和委托配制单位。需要变更的，申请人应当提出补充申请，报送相关资料，经批准后方可执行。医疗机构制剂批准文号的有效期为3年。有效期届满需要继续配制的，申请人应当在有效期届满前3个月按照原申请配制程序提出再注册申请，报送有关资料。医疗机构制剂的批准文号格式为：×药制字H（Z）＋4位年号＋4位流水号。其中，×—省、自治区、直辖市简称，H—化学制剂，Z—中药制剂。《中医药法》规定，医疗机构配制中药制剂，应当依照《药品管理法》的规定取得医疗机构制剂许可证，或者委托取得药品生产许可证的药品生产企业、取得医疗机构制剂许可证的其他医疗机构配制中药制剂。委托配制中药制剂，应当向委托方所在地省、级药品监督管理部门备案。医疗机构配制的中药制剂品种，应当依法取得制剂批准文号。但是，仅应用传统工艺配制的中药制剂品种，向医疗机构所在地省级药品监督管理部门备案后即可配制，不需要取得制剂批准文号。《医疗机构制剂许可证》应当标明有效期，有效期为5年（E错），到期重新审查发证。《麻醉药品、第一类精神药品运输证明》有效期为1年（A错）（不跨年度）。运输证明应当由专人保管，不得涂改、转让、转借。